佐剂是
A. 超抗原的一种
B. 免疫球蛋白的一种
C. 非特异性免疫增强物质
D. 特异性免疫增强物质
E. 非特异性免疫抑制物质

正确答案：C。非特异性免疫增强物质